子宫颈癌最早出现的症状是
A. 尿频、尿急
B. 接触性出血
C. 进行性下肢肿痛
D. 大量米汤恶臭白带
E. 绝经后长期阴道流血

正确答案：B。接触性出血

解析：子宫颈癌最早出现的症状是接触性出血（B对）。大量米汤恶臭白带（D错）、尿频尿急（A错）、进行性下肢肿痛（C错）为晚期症状。绝经后长期阴道流血（E错）为老年患者子宫颈癌的晚期表现。